根据《处方管理办法》，吗啡缓释片用于门诊癌症疼痛患者的处方最大量为
A. 一次常用量
B. 3日常用量
C. 5日常用量
D. 7日常用量
E. 15日常用量

正确答案：E。15日常用量

解析：本题考察处方管理。《处方管理办法》第二十四条：为门（急）诊癌症疼痛患者和中、重度慢性疼痛患者开具的麻醉药品、第一类精神药品注射剂，每张处方不得超过3日常用量；控缓释制剂，每张处方不得超过15日常用量（E对）；其他剂型，每张处方不得超过7日常用量。